患者，女，21岁。发热腹痛，里急后重，便痢脓血，舌红苔腻，脉滑数。用药宜首选
A. 金银花、连翘
B. 黄连、黄柏
C. 马齿苋、秦皮
D. 白头翁、黄连
E. 穿心莲、白头翁

正确答案：D。白头翁、黄连

解析：发热腹痛，里急后重，便痢脓血，舌红苔腻，脉滑数，为热毒血痢的典型表现，治疗当用白头翁配伍黄连，清热解毒，凉血止痢。（D对ABCE错）。